在雌、孕激素作用下，出现周期性变化最显著的是
A. 子宫内膜
B. 宫颈上皮
C. 输卵管粘膜
D. 阴道粘膜
E. 卵巢表面上皮

正确答案：A。子宫内膜

解析：在雌、孕激素作用下，出现周期性变化最显著的是子宫内膜（A对），子宫内膜功能层受雌孕激素变化的调节，具有周期性增殖、分泌和脱落性变化。宫颈上皮（B错）、输卵管粘膜（C错）、阴道黏膜（D错）都可发生周期性变化，但是没有子宫内膜周期性变化显著。卵巢生发上皮（E错）是覆盖在卵巢表面的单层立方上皮，不发生周期性变化。